重证见口和齿润，小便清长，夜卧安静，并无潮热，其辨证为
A. 心善
B. 肝善
C. 脾善
D. 肺善
E. 肾善

正确答案：E。肾善

解析：本题考查五善的内容，需理解记忆。肾为先天之本，主骨生髓，司膀胱开合，故肾善可见身无潮热，口和齿润，小便清长，夜卧安静（E对）。心善表现为精神爽快，言语清亮，舌润不渴，寝寐安宁（A错）。肝善表现为身体轻便，不怒不惊，指甲红润，二便通利（B错）。脾善表现为唇色滋润，饮食知味，脓黄而稠，大便和润（C错）。肺善表现为声音响亮，不咳不喘，呼吸均匀，皮肤润泽（D错）。